正中孔、外侧孔的位置在
A. 侧脑室
B. 第三脑室
C. 第四脑室
D. 蛛网膜
E. 上述都不是

正确答案：C。第四脑室

解析：正中孔、外侧孔的位置在第四脑室（C对），第四脑室通过单一的正中孔、成对的外侧孔与蛛网膜下隙相通，脑室系统内的脑脊液经上述3个孔注入蛛网膜下隙的小脑延髓池。